脊髓灰质炎、甲型肝炎等病毒的结构组成是
A. 核酸和刺突
B. 衣壳和包膜
C. 基质蛋白和衣壳
D. 核酸和包膜
E. 核酸和衣壳

正确答案：E。核酸和衣壳